男孩，6岁。因发热2周，头痛伴呕吐3天，惊厥1次入院。疑诊结核性脑膜炎。确诊该病的最主要依据是
A. 脑脊液中找到结核杆菌
B. 结核菌素试验阳性
C. 头颅CT示脑室扩大、脑实质改变
D. 脑脊液蛋白增高，糖、氯化物降低
E. 脑脊液外观呈毛玻璃样

正确答案：A。脑脊液中找到结核杆菌

解析：所有选项的描述本身都是正确的，但结核性脑膜炎确诊最主要的依据是脑脊液中找到结核杆菌，这是最直接、最准确的方式（A对）。